丁香除了温肾助阳外，又能
A. 杀虫止痒
B. 温经止血
C. 温中降逆
D. 杀虫消积
E. 温肺化饮

正确答案：C。温中降逆

解析：本题考查的是丁香的功效。丁香除了温肾助阳外，又能温中降逆（C对）。丁香：【功效】温中降逆，温肾助阳。花椒：【功效】温中止痛，杀虫止痒（A错）。艾叶：【功效】温经止血（B错），散寒止痛。使君子：【功效】杀虫消积（D错）。干姜：【功效】温中，回阳，温肺化饮（E错）。